味觉减退或异食癖可能是由于缺乏
A. 锌
B. 铬
C. 硒
D. 钙
E. 碘

正确答案：A。锌